一般3岁时平均身长约为
A. 75cm
B. 80cm
C. 85cm
D. 90cm
E. 94cm

正确答案：E。94cm

解析：身高（长）一般1岁时达75cm，2岁时达87cm，2岁后到12岁前（青春期前）平均每年约增加6～7cm，青春期身高加速增长。掌握“体格生长常用指标”知识点。